呕血呈暗红色，是由于
A. 在胃中停留时间长，被氧化
B. 是静脉血，非动脉血
C. 血红蛋白与胃酸结合而变性
D. 患者在缺氧情况下发生呕血
E. 血红蛋白与硫化物结合而变性

正确答案：C。血红蛋白与胃酸结合而变性

解析：呕血是上消化道疾病或全身性疾病所致的上消化道出血，血液经口腔呕出。呕血呈暗红色，是由于血红蛋白与胃酸结合而变性（C对）而致，具体机制为血红蛋白经酸作用后变成酸化正铁血红蛋白。